肾小球源性血尿的特点是
A. 变形红细胞尿
B. 终末血尿
C. 尿痛伴血尿
D. 初始血尿
E. 有凝血块的尿

正确答案：A。变形红细胞尿

解析：肾小球源性血尿的特点是变形红细胞尿（A对）。因肾小球源性血尿产生的主要原因为GBM（肾小球基底膜）断裂，红细胞通过该裂缝时受血管内压力挤压受损，受损的红细胞其后通过肾小管各段又受不同渗透压和pH作用，呈现变形红细胞血尿，红细胞容积变小，甚至破裂。终末血尿（B错）提示出血部位在膀胱颈部、三角区或后尿道的前列腺和精囊腺。尿痛血尿（C错）提示下尿路感染。初始血尿（D错）提示病变部位在尿道。血凝块伴血尿（E错）提示病变在膀胱或前列腺。